上述各项，体现在医患关系中，体现病人自主性的是
A. 医患交往的社会性日益突出为社会所关注
B. 将部分医德规范，观念纳入《中华人民共和国执业医师法》
C. 医患交往在经济条件文化背景方面日显重要
D. 指导患者就医，自主选择医生护士治疗小组的做法
E. 部分医务人员在诊疗工作中过于依靠仪器检测

正确答案：D。指导患者就医，自主选择医生护士治疗小组的做法

解析：体现在医患关系中，体现病人自主性的是指导患者就医，自主选择医生护士治疗小组的做法。医生在确定最终诊疗方案时，更需要尊重其自主。具体思路是医生要加强与患者的沟通（D对）。